正确描述背阔肌的是
A. 是全身最大的扁肌
B. 位于背上部浅层
C. 起于全部胸椎棘突
D. 止于肱骨大结节嵴
E. 作用可下降肩胛骨

正确答案：A。是全身最大的扁肌

解析：背阔肌是全身最大的扁肌（A对），位于背的下半部及胸的后外侧，而非背上部（B错），起于下6个胸椎棘突，而非全部胸椎棘突（C错），止于肱骨小结节嵴，而非肱骨大结节嵴（D错），作用是使肩关节后伸、内收及旋内，而非下降肩胛骨（E错）。